男，50岁。间断水肿3年，加重伴乏力1个月。3年来反复出现颜面和双下肢水肿，未予诊治。1个月来水肿加重，查体：BP170/85mmHg，双下肢中度水肿，尿常规：尿RBC（-），蛋白（++）。血Hb70g/L，SCr865μmol/L，K⁺6.5mmol/L，Ca²⁺1.79mmol/L，全段甲状旁腺激素（iPTH）710pg/ml，需要紧急处理的临床情况是
A. 血K⁺6.5mmol/L
B. 血Ca²⁺1.79mmol/L
C. 血Hb70g/L
D. 血SCr865μmol/L
E. 血iPTH710pg/ml

正确答案：A。血K⁺6.5mmol/L

解析：老年男性患者，间断水肿3年（水、钠潴留引起），加重伴乏力1个月。3年来反复出现颜面和双下肢水肿（肾功能不全表现）。一个月来水肿加重。查体：BP170/85mmHg（正常为90～130/60～90mmHg，提示血压升高）。血红蛋白70g/L（男性正常为120～160g/L，考虑肾性贫血），血肌酐865μmol/L（正常值为88.4～176.8μmol/L，提示血肌酐升高），可考虑该患者为慢性肾衰竭急性发作，根据我国慢性肾衰竭的分期方法判断（血肌酐≥707μmol/L为尿毒症阶段），患者处于尿毒症期。血钾6.5mmol/L（正常3.5～5.5mmol/L，提示血钾升高），可导致心脏骤停，需紧急处理，最有效的治疗手段为及时紧急透析（A对）。血钙1.79mmol/L（正常值2.25mmol/L～2.75mmol/L）（B错），血红蛋白70g/L（男性正常为120～160g/L）（C错），考虑为肾性贫血，血SCr865μmol/L（D错），防治肾性骨病，低血钙者要补充钙剂。全段甲状旁腺激素iPTH710pg/ml（正常参考值为10～65pg/ml，iPTH的目标值为150～200pg/ml），都应积极治疗，但最应该处理高钾血症，以防止心脏骤停危及患者生命。